甘露醇注射剂静注用于
A. 颅内压升高与青光眼
B. 妊娠高血压
C. 急性皮炎
D. 经尿道行前列腺切除术
E. 慢性胆囊炎

正确答案：A。颅内压升高与青光眼

解析：本题考查甘露醇的用法。甘露醇注射液静脉滴注可用于各种原因的脑水肿、颅内压增高和青光眼（A对），作为冲洗剂可用于经尿道行前列腺切除术（D错）。